关于纯化水的说法，错误的是
A. 可作为制备中药注射剂所用饮片的提取溶剂
B. 可作为制备中药滴眼剂所用饮片的提取溶剂
C. 可作为配制口服制剂的溶剂
D. 可作为配制外用制剂的溶剂
E. 可作为配制注射剂的溶剂

正确答案：E。可作为配制注射剂的溶剂

解析：本题考查纯化水的应用范围。纯化水不得用于注射剂的配制（E错，为本题正确答案）与稀释。纯化水可作为配制普通药物制剂用的溶剂或试验用水；中药注射剂、滴眼剂等灭菌制剂所用纯化水饮片的提取溶剂（AB对）；口服、外用制剂配制用溶剂（CD对）或稀释剂；非灭菌制剂用器具的精洗用水。也可作非灭菌制剂所用饮片的提取溶剂。